支气管肺炎发生在小儿，主要表现是
A. 可出现三角形的肺不张，尖端指向肺门
B. 脊柱旁及心脏边缘部病变较多
C. 肺门增大模糊，伴局限性肺气肿改变
D. 不局限于一个肺野或肺段的密度增高阴影
E. 两肺中下部内外带，沿肺纹理分布的病变

正确答案：C。肺门增大模糊，伴局限性肺气肿改变

解析：支气管肺炎发生在小儿，主要表现是肺门增大模糊，伴局限性肺气肿改变。骤发的有发热、呕吐、烦躁及喘憋等症状。发病前可先有数天轻度上呼吸道感染症状，早期体温多在38℃～39℃。咳嗽及咽部痰声一般在早期就很明显。早期为干咳，极期咳嗽可减少，可出现发绀。严重者呼吸困难，重者呈点头状呼吸、三凹征、呼气时间延长等（C对）。肺不张时可出现三角形的肺不张，尖端指向肺门（A错）。不局限于一个肺野或肺段的密度增高阴影多见于炎症（D错）。两肺中下部内外带，沿肺纹理分布的病变见于肺部感染（E错）。